流感病毒易于发生变异的主要原因是
A. 核蛋白抗原
B. 表面抗原
C. 膜蛋白抗原
D. 其基因组由8个节段的单链RNA组成
E. 类脂质

正确答案：D。其基因组由8个节段的单链RNA组成

解析：本题考查流感病毒易于发生变异的主要原因。流感病毒的基因组由8个节段的单链RNA组成（D对ABCE错），及流感病毒RNA在复制过程中不具有校正功能，决定了流感病毒易于发生变异，并且不同毒株之间也易于发生基因重配。